异烟肼的鉴别方法有
A. 与硫酸铜试液反应，生成草绿色沉淀
B. 与香草醛反应生成黄色结晶，熔点为228℃～231℃
C. 与氨制硝酸银试液反应，产生气泡与黑色沉淀
D. 在酸性条件下加热后，加亚硝酸钠和碱性β-萘酚溶液，产生红色沉淀
E. 红外光谱法

正确答案：B、C、E。与香草醛反应生成黄色结晶，熔点为228℃～231℃；与氨制硝酸银试液反应，产生气泡与黑色沉淀；红外光谱法